自来水及游泳池水的消毒可用
A. 0.01%～0.1%硫柳汞
B. 1%硝酸银
C. 3%～6%过氧化氢
D. 含有0.2～0.5ppm氯
E. 生石灰

正确答案：D。含有0.2～0.5ppm氯

解析：卤素及其化合物：10%～20%漂白粉上清液，用于地面、厕所及排泄物消毒。每升水中加入5～10mg漂白粉，用于浅层地表水的饮水消毒。0.2%～0.5%氯胺，用于物品表面及空气喷雾消毒。含有0.2～0.5ppm（1ppm＝1mg/L）氯浓度，用于自来水及游泳池水的消毒。2%碘酊，用于皮肤消毒。掌握“消毒与灭菌”知识点。